氨基酸首先通过连续的转氨基作用将氨基转移给草酰乙酸，生成
A. 天冬氨酸
B. 氨基甲酰磷酸
C. 谷氨酸
D. 次黄嘌呤核苷酸
E. 赖氨酸

正确答案：A。天冬氨酸

解析：氨基酸首先通过连续的转氨基作用将氨基转移给草酰乙酸，生成天冬氨酸；天冬氨酸与次黄嘌呤核苷酸（IMP）反应生成腺苷酸代琥珀酸，后者经过裂解，释放出延胡索酸并生成腺嘌呤核苷酸（AMP）。掌握“氨基酸及氨的代谢”知识点。